正常胎儿的脐带内含有
A. 一条脐动脉，一条脐静脉
B. 两条脐动脉，一条脐静脉
C. 两条脐动脉，两条脐静脉
D. 一条脐动脉，两条脐静脉
E. 两条脐动脉

正确答案：B。两条脐动脉，一条脐静脉

解析：脐带表面有羊膜覆盖呈灰白色，内有两条脐动脉，一条脐静脉（B对）。